关于癫痫的治疗原则，下列说法错误的是
A. 初次发作后，可暂不服药
B. 应根据不同发作类型选药
C. 一种药物无效，立即停药，换用另外一种药物
D. 坚持长期规律用药
E. 尽可能单药治疗

正确答案：C。一种药物无效，立即停药，换用另外一种药物

解析：血清药浓度已达到该药“治疗范围”浓度而无效或发生病人不能耐受的副作用，应考虑更换药物或与他药合并治疗。但需注意更换新药时不可骤停原药（C对）。单次发作的病人是否应开始长期药物治疗，要根据病人具体情况如发作类型、年龄、诱因、既往病史、家族史、有否阳性体征、EEG、有否脑结构性改变、突然意识丧失可能招致的危险等资料进行全面考虑后作出决定（AB错）。癫痫是一种需长期治疗的疾病，患者应树立信心。特发性癫痫在控制发作1～2年后，非特发性癫痫在控制发作3～5年后才减量或停药，部分患者终身服药，所以主张长期坚持服用（D错）。单药治疗是癫痫的重要原则，单个药物治疗数周（E错）。